在进行队列研究时，暴露队列必须
A. 有相同的出生年代
B. 经过相同的观察期限
C. 居住在共同地区
D. 暴露于同种因素
E. 有共同的疾病史

正确答案：D。暴露于同种因素

解析：本题考查队列的概念。队列表示一个特定的研究人群，具有某种共同暴露或特征的一组人群，可称为某暴露队列。在进行队列研究时，暴露队列必须暴露于同种因素（D对ABCE错）。